材料二，A制药公司是一家现代化企业，许多产品在市场上口碑很好，B制药公司为获取更大利润，将自己产品的包装盒装潢设计的与A制药公司同类药品非常相似，并在印制药品说明书和标签假冒了A制药公司的注册商标，同时做了宣传和广告。如果上述信息中的B企业的药品广告批准文号属于提供虚假材料申请而取得，药品广告审查机关应当撤销药品广告批准文号，同时还应
A. 3年内不受理该企业该品种的广告审批申请
B. 1年内不受理该企业该品种的广告审批申请
C. 1年内不受理该企业所有品种的广告审批申请
D. 3年内不受理该企业所有品种的广告审批申请

正确答案：D。3年内不受理该企业所有品种的广告审批申请

解析：本题考查违反药品广告管理的处罚。材料二，A制药公司是一家现代化企业，许多产品在市场上口碑很好，B制药公司为获取更大利润，将自己产品的包装盒装潢设计的与A制药公司同类药品非常相似，并在印制药品说明书和标签假冒了A制药公司的注册商标，同时做了宣传和广告。如果上述信息中的B企业的药品广告批准文号属于提供虚假材料申请而取得，药品广告审查机关应当撤销药品广告批准文号，同时还应3年内不受理该企业所有品种的广告审批申请（D对）。违反药品广告管理，以不当方式获得批准文件：隐瞒真实情况或者提供虚假材料申请药品、医疗器械、保健食品和特殊医学用途配方食品广告审查的；或者以欺骗、贿赂等不正当手段取得药品、医疗器械、保健食品和特殊医学用途配方食品广告批准文号的，按照《广告法》第六十五条处罚，广告审查机关不予受理或者不予批准，予以警告，一年内不受理该申请人的广告审查申请（C错）；以欺骗、贿赂等不正当手段取得广告审查批准的，广告审查机关予以撤销，处十万元以上二十万元以下的罚款，三年内不受理该申请人的广告审查申请。